何首乌属于
A. 蓼科
B. 木兰科
C. 芸香科
D. 茄科
E. 马兜铃科

正确答案：A。蓼科

解析：本题考查的是何首乌的来源。何首乌属于蓼科（A对）。何首乌：【来源】为蓼科植物何首乌的干燥块根。来源于木兰科（B错）的中药有厚朴、辛夷、五味子、南五味子等。来源于芸香科（C错）的中药有黄柏、关黄柏、白鲜皮、枳壳、吴茱萸等。来源于茄科（D错）的中药有地骨皮、洋金花、枸杞子、天仙子等。来源于马兜铃科（E错）的中药有马兜铃、细辛等。